影响药材质量的因素
A. 品种种质
B. 产地和生态环境
C. 栽培技术
D. 采收和产地加工
E. 包装与贮运

正确答案：A、B、C、D、E。品种种质；产地和生态环境；栽培技术；采收和产地加工；包装与贮运

解析：本题考查的是影响药材质量的因素。影响药材质量的因素品种种质（A对）、产地和生态环境（B对）、栽培技术（C对）、采收和产地加工（D对）、包装与贮运（E对）。中药材生产过程中的品种、产地、种养环境、采收加工及贮藏养护等因素都会影响药材质量。